对职业性噪声聋的分级必须排除的影响因素是
A. 接触噪声的时间
B. 性别
C. 年龄
D. 接触噪声的强度
E. 工龄

正确答案：C。年龄

解析：本题考查职业性噪声聋的分级的影响因素。听力会随着年龄的增长而产生较大变化，因此对职业性噪声聋的分级必须排除的影响因素是年龄（C对ABDE错）。